右淋巴导管收集
A. 右半身的淋巴
B. 右侧上半身的淋巴
C. 右下平身的淋巴
D. 下半身加右上半身
E. 无

正确答案：B。右侧上半身的淋巴

解析：右淋巴导管引流右上肢、右胸部和右头颈部的淋巴，即右侧上半身的淋巴（B对）由右淋巴导管收集。胸导管引流下肢、盆部、腹部、左上肢、左胸部和左头、颈部的淋巴，即全身 3/4 部位的淋巴。